女，45岁，四肢无力，站立不稳，进行性加重半年，无外伤史。查体：双下肢肌张力高、腱反射亢进。Hoffmann征（+），Babinski征（+）。应首先选择的治疗方法是
A. 理疗
B. 手术治疗
C. 推拿按摩
D. 颏枕带牵引
E. 带围领和颈托

正确答案：B。手术治疗

解析：女，45岁。四肢无力，站立不稳（提示颈椎节段以上平面脊椎可能存在损伤），进行性加重半年，无外伤史（排出由急性外伤所引起的脊髓损伤）。查体：双下肢肌张力高、腱反射亢进。Hoffmann征（+），Babinski征（+）（提示高位脊髓损伤）。其诊断为脊髓型颈椎病。应首先选择的治疗方法是手术治疗（B对）。颈椎病合并脊髓损伤一般较重，若不及时处理，病情进一步发展可能会引起严重后果，故一经确诊，需立即采取手术治疗，常见术式为颈椎前路或后路手术。理疗（A错）、推拿按摩（C错）、颏枕带牵引（D错）、带围领和颈托（E错）均有可能造成颈椎退变结构移位压迫脊髓，引起更严重的损伤，这类可能造成颈椎移位的治疗方式可用于神经根型、椎动脉型、交感神经型颈椎病，但唯独不能用于脊髓型颈椎病。